影响生物转运的因素不包括
A. 外源化学物的结构
B. 分子量大小
C. 脂水分配系数的大小
D. 外源化学物自身能量

正确答案：D。外源化学物自身能量

解析：本题考查影响生物转运的因素。外来化学物从体外吸收、在体内分布和排泄出体外的过程称为生物转运。影响生物转运的因素包括外源化学物的结构（A对）、分子量大小（B对）、脂水分配系数的大小（C对）等。外源化学物自身能量（D错，为本题正确答案）不是影响生物转运的因素。